国务院卫生行政部
A. 不得伪造、涂改、出借卫生许可证
B. 负责城乡集市贸易的食品卫生管理工作
C. 主管全国食品卫生监督管理工作
D. 实行食品卫生监督制度
E. 负责各类食品市场内的食品卫生管理工作

正确答案：C。主管全国食品卫生监督管理工作